凌晨，一位被汽车撞成重伤的少校军官被一位好心的老工人用三轮车送到某市医院急诊室。值班医师问刚刚苏醒过来的少校：“带钱了吗？”少校摇了摇头，又赶紧吃力地说：“我是现役军人，能报销……”话未说完又昏迷过去。医生给当地部队打电话。未能搞清伤者身份，于是睡觉去了。到早晨交接班时，发现少校军官已死于候诊室外长椅上。事后，某报记者走访了当事医师。他很委屈地说：“我多倒霉呀！白受了个处分。半夜里，他既没钱又没有伴，我怎么能相信他的话呢？医院里病人住院一分钱不交就溜走的还少吗？你去试试，不先交钱就给你看病的医院有哪家？”医师在接诊此类忠者时的最佳伦理选择应该是
A. 恪守先交钱，然后给予检查、处置、收人院、抢救的规定
B. 先积极抢救，然后再恰当解决收费问题
C. 只管抢救，收费是别人的事
D. 把棘手患者推给上级医生
E. 以上都不对

正确答案：B。先积极抢救，然后再恰当解决收费问题